患者大便稀溏，纳差，腹胀，食后尤甚，舌淡白有齿痕。其证候是
A. 脾气虚
B. 脾阳虚
C. 寒湿困脾
D. 食滞胃脘
E. 命门火衰

正确答案：A。脾气虚

解析：患者纳差腹胀为脾气虚弱，运化失职，输精、散精无力，水湿不运所致；食后脾气愈困，故食后尤甚；脾虚失运，水湿下注肠道，故大便稀溏；舌淡白有齿痕为脾虚之象，故其证候为脾气虚（A对）。脾阳虚较脾气虚有畏冷肢凉、脘腹隐痛喜温等寒象（B错）。寒湿困脾有泛恶欲吐，头身困重等湿象（C错）。食滞胃脘大便酸馊腐臭，腹痛拒按，吐后痛减等症状（D错）。命名火衰有五更泄泻，腰膝酸冷疼痛，畏冷肢凉的症状（E错）。